不得检出残留的兽药是
A. 咖啡因
B. 金霉素
C. 氯霉素
D. 青霉素
E. 安定

正确答案：E。安定

解析：本题考查不得检出残留的兽药。不得检出残留的兽药有安定（E对ABCD错）、甲硝唑和赛拉嗪等。